土壤长期过量施用氮肥，会导致蔬果
A. 硝酸盐和亚硝酸盐含量增加
B. 镉含量超标
C. 易被肠道致病菌污染
D. 保质期延长
E. 无明显成熟期

正确答案：A。硝酸盐和亚硝酸盐含量增加

解析：本题考查土壤长期过量施用氮肥对蔬果的影响。土壤长期过量施用氮肥，会导致蔬果硝酸盐和亚硝酸盐含量增加（A对BCDE错）。